伤寒最具特征性的病变部位在
A. 肝、胆囊
B. 肠系膜淋巴结
C. 结肠
D. 回肠下段淋巴结
E. 乙状结肠

正确答案：D。回肠下段淋巴结